Kennedy第一类缺失中混合支持式义齿特点是
A. 加速牙槽嵴吸收
B. 义齿由天然牙和黏膜共同支持
C. 适宜于双侧后牙部分或全部缺失
D. 后牙缺失越多，对基牙和牙槽嵴的损害越大
E. 以上说法均正确

正确答案：E。以上说法均正确

解析：Kennedy第一类缺失设计要点：混合支持式义齿：此种设计适宜于双侧后牙部分或全部缺失、余留牙健康的情况下。①特点：义齿由天然牙和黏膜共同支持，因此义齿不稳定，沿支点线、回转线活动，其结果导致基牙受扭力，鞍基下的软组织受到创伤，最终导致基牙松动，黏膜疼痛，加速牙槽嵴吸收。后牙缺失越多，对基牙和牙槽嵴的损害越大。掌握“局部义齿的设计”知识点。